观察法的缺点或局限性在于它的
A. 有效性
B. 可靠性
C. 说服力
D. 时间弹性

正确答案：D。时间弹性

解析：本题考查观察法的缺点或局限性。观察法是研究者通过对事件或研究对象的行为进行直接的、系统的观察来收集数据的方法，是一种收集非言语行为资料的主要技术。该方法的缺点或局限性在于它的时间弹性（D对ABC错），因为参与性观察常常要花费几个月甚至更长的时间，对许多研究人员来说可能难以进行的。